根据《医疗事故处理条例》下列情况中属于二级医疗事故的是
A. 中期残疾或者器官组织损伤导致一般功能障碍
B. 轻度残疾或者器官组织损伤导致一般功能障碍
C. 轻度残疾或者器官组织损伤导致严重功能障碍
D. 中度残疾或者器官组织损伤导致严重功能障碍
E. 造成明显人身损害的其他后果

正确答案：D。中度残疾或者器官组织损伤导致严重功能障碍

解析：本题考查二级医疗事故。《医疗事故处理条例》根据对患者人身造成的损害程度，医疗事故分为四级：一级医疗事故：造成患者死亡、重度残疾的；二级医疗事故：造成患者中度残疾、器官组织损伤导致严重功能障碍的（D对ABCE错）；三级医疗事故：造成患者轻度残疾、器官组织损伤导致一般功能障碍的；四级医疗事故：造成患者明显人身损害的其他后果的。